男，35岁，腰痛伴右侧下肢放射性疼痛3个月，无明显发热盗汗。查体：右下肢直腿抬高试验阳性，小腿前外侧和足内侧感觉感觉减退，拇背伸肌力减退。最合适的治疗方法是
A. 联合应用抗生素
B. 卧床休息，牵引治疗
C. 抗结核药物治疗
D. 单纯椎板减压术
E. 髓核摘除术

正确答案：B。卧床休息，牵引治疗

解析：青年男性患者，腰痛伴右侧下肢放射性疼痛（腰椎间盘突出症典型表现），右下肢直腿抬高试验阳性（腰椎间盘突出症重要体征），小腿前外侧和足底感觉减退，�背伸肌力减退（提示为腰5神经根受累），结合患者症状、体征及体查，该患者最可能的诊断为腰4-5椎间盘突出症。患者较年轻，初次发病，病程仅3个月，且无马尾神经受累症状，故最合适的治疗方法是为非手术治疗，即卧床休息、牵引理疗（B对）等。单纯椎板减压手术（D错）、髓核摘除术（E错）均为手术治疗方法，适用于腰腿痛症状严重影响工作和生活者、有马尾神经综合征及有明显的神经受累表现者。腰椎间盘突出症主要由椎间盘退变、损伤等因素导致，不是感染性疾病，故无需联合应用抗生素（A错）。患者无明显发热、盗汗，提示无结核杆菌感染，无需使用抗结核药物治疗（C错）。